下列各因素中，属于影响传染病流行过程的自然因素是
A. 人口密度
B. 气候、地理
C. 宗教信仰
D. 经济、文化
E. 生产及生活条件

正确答案：B。气候、地理